某患者行带蒂皮瓣术后，其断蒂手术一般在第一次手术后多久实施
A. 7天
B. 7～10天
C. 14～21天
D. 21～30天
E. 30天后

正确答案：C。14～21天

解析：需断蒂者，一般在术后14～21天进行。掌握“皮瓣移植”知识点。